患者男性，28岁。右颈部淋巴结结核，下列哪种药物对治疗无效
A. 青霉素
B. 链霉素
C. 异烟肼
D. 利福平
E. 乙胺丁醇

正确答案：A。青霉素

解析：本题考查结核性淋巴结炎的药物治疗。患者男性，28岁。右颈部淋巴结结核，对治疗无效的是青霉素（A错，为本题正确答案）。青霉素是口腔颌面放线菌病的常用药物。结核性淋巴结炎的常用药物为异烟肼（C对）、利福平（D对）、吡嗪酰晦、乙胺丁醇（E对）、链霉素（B对）等。